下列关于效能与效价强度的说法，错误的是
A. 效能和效价强度常用于评价同类不同品种的作用特点
B. 效能表示药物的内在活性
C. 效能表示药物的的最大效应
D. 效价强度表示可引起等效反应对应的剂量或浓度
E. 效能值越大效价强度就越大

正确答案：E。效能值越大效价强度就越大

解析：本题考查效能和效价。下列关于效能与效价强度的说法，错误的是效能和效价强度反映药物的不同性质（E错，为本题正确答案）。效能和效价强度反映药物的不同性质，二者具有不同的临床意义，常用于评价同类药物中不同品种的作用特点（A对）。效能反映了药物的内在活性（B对），在质反应中阳性率100%。在一定范围内，增加药物剂量或浓度，其效应随之增加，但效应增至一定程度时，若继续增加剂量或浓度而效应不再继续增强，此药理效应的极限称为最大效应（C对），也称效能。效价强度是指能引起等效反应（一般采用50%效应量）的相对剂量或浓度（D对）。